肝破裂的临床特点中，正确的是
A. 在腹部损伤中罕见
B. 腹痛和腹膜刺激征较轻
C. 中央型破裂不易继发肝脓肿
D. 有时可出现呕血或黑粪
E. 被膜下破裂更易继发肝脓肿

正确答案：D。有时可出现呕血或黑粪

解析：肝破裂后的血液可经胆管进入消化道，出现呕血或黑粪（D对）。肝破裂约占所有腹部损伤的20%～30%，在腹部开放性损伤中占首位（约37%），在腹部闭合性损伤中占第四位，因此外伤性肝破裂并不少见（A错）。肝脏可以分泌胆汁，而胆汁是对腹膜刺激最强的物质之一，因此肝破裂时大量胆汁流入腹腔，可刺激壁层腹膜引起剧烈腹痛及严重的腹膜刺激征（B错）；中央型肝破裂容易形成血肿，易发展为肝脓肿（C错）；肝被膜下破裂可转变为真性破裂，不易继发肝脓肿（E错）。